在进行大气污染对人群健康影响的调查时，所选择调查对象应在该地区连续居住
A. 1年以上
B. 3年以上
C. 5年以上
D. 7年以上
E. 10年以上

正确答案：C。5年以上

解析：本题考查大气污染对人群健康影响的调查。大气污染的影响是多方面的，不仅仅是对人群健康的影响，还包括对环境、社会和经济的影响，而且大气污染的影响是持久的，因此，要想准确地掌握大气污染对人群健康的影响，就必须要求调查对象在该地区连续居住一段较长的时间，以便观察到污染物对人群健康的慢性影响。因此，5年以上（C对ABDE错）是最佳的选择。